冲洗智齿冠周炎的过氧化氢溶液的浓度是
A. 1％～3％
B. 0.1％～0.3％
C. 0.3％～0.5％
D. 0.25％～0.5％
E. 5％～10％

正确答案：A。1％～3％

解析：本题考查冲洗智齿冠周炎的过氧化氢溶液的浓度。智牙冠周炎的治疗以局部处理为重点，局部又以清除龈袋内食物碎屑、坏死组织、脓液为主。常用生理盐水、1％～3％（A对）的过氧化氢溶液、1：5000高锰酸钾溶液、0.1％氯己定（洗必泰）液等反复冲洗龈袋，至溢出液清亮为止。过氧化氢溶液浓度太低，无法有效起到杀菌作用；浓度太高，容易刺激软组织甚至烧伤皮肤及患处。